影响刺激性气体作用部位的主要因素是
A. 化学结构
B. 接触时间
C. 环境温度
D. 气体浓度
E. 水溶解度

正确答案：E。水溶解度

解析：本题考查影响刺激性气体作用部位的因素。刺激性气体导致的病变部位与其水溶性（E对ABCD错）有关，水溶性高的毒物易溶解附着在湿润的眼和上呼吸道黏膜局部，立即产生刺激作用。中等水溶性的毒物，其作用部位与浓度有关，低浓度时只侵犯眼和上呼吸道，高浓度时则可侵犯全呼吸道。水溶性低的毒物，通过上呼吸道时溶解少，故对上呼吸道刺激性较小，易进入呼吸道深部，对肺组织产生刺激和腐蚀。